女，48岁，左乳房无痛性肿物2月余。查体：左乳外上象限有1.0cm×1.5cm×1.0cm肿块，无压痛，表面不光滑，界限不清，活动度尚可。最确切的检查是
A. CT
B. 乳腺B超
C. 钼靶X线检查
D. 红外线扫描
E. 肿物完整切除病理检查

正确答案：E。肿物完整切除病理检查

解析：青年女性患者，左乳房无痛性肿物2月余，表面不光滑，界限不清，活动度尚可，需考虑乳腺癌可能。确定乳腺肿块性质最可靠的方法是肿物完整切除病理检查（E对），通过观察细胞形态及局部组织结构做出定性诊断。CT（A错）适用于检查致密型乳腺内的病灶，可直接观察肿块的三维结构及淋巴结转移；乳腺B超（B错）主要用于鉴别肿块系囊性还是实性；钼靶X线检查（C错）主要用于乳腺癌的普查；红外线扫描（D错）主要用于观察乳腺增生及血管分布情况，以上四种影像学检查均不能明确诊断。